患者，女，60岁。双侧腮腺反复肿大十余年，有脂肪肝、糖尿病病史。一侧腮腺造影显示：腺实质内可见一腺泡充盈缺损，边缘光滑完整，分支导管受压移位；部分末梢导管呈球状扩张，主导管不均匀扩张。初步可以排除以下哪种情况
A. 成人复发性腮腺炎
B. 涎腺良性肥大
C. 涎腺良性肿瘤
D. 高度恶性肿瘤
E. 舍格伦综合征

正确答案：D。高度恶性肿瘤

解析：本题考查舍格伦综合征。高度恶性肿瘤（D错，为本题正确答案）涎腺造影片表现为不规则腺泡充盈缺损，造影剂外溢，导管破坏中断。